患者，40岁，左上6深龋洞，有长期的食物嵌入痛。查：左上6（牙合）面龋洞口小，探之软，冷刺激较敏感，去尽腐质时发现有露髓孔，则应诊断为
A. 中龋
B. 深龋
C. 慢性牙髓炎
D. 可复性牙髓炎
E. 急性浆液性牙髓炎

正确答案：C。慢性牙髓炎

解析：本题考查慢性牙髓炎。患牙有长期的食物嵌塞痛，冷刺激较敏感，深龋洞去净腐质有露髓孔出现龋源性露髓孔，可诊断为慢性牙髓炎（C对）。中龋（A错）、深龋（B错）去净腐质一般没有露髓孔。可复性牙髓炎（D错）冷刺激时有一过性敏感，刺激去除后疼痛立即消失。急性浆液性牙髓炎（E错）有自发痛阵发痛、冷热刺激痛、夜间痛、不定位痛、放散性痛。